衡量人群中在短时间内新发病例的频率，采用的指标为
A. 罹患率
B. 发病率
C. 患病率
D. 感染率
E. 发病比

正确答案：A。罹患率

解析：罹患率和发病率均为衡量新发病例频率的指标，两者区别主要为罹患率一般多用于小范围、短时间的发病频率（A对），以日、周、旬、月为时间单位，观察期限较短，而发病率一般以一年为时间单位（B错）。患病率是在特定时间内、一定人群中某病新旧病例数所占的比例，并不只衡量新发病例（C错）。感染率性质和患病率相似，不强调新发病例（D错）。流行病学中没有发病比这一概念，并且比是说明两者的相对水平，与率不同，它并不能反映新发病例发生的频率（E错）。